男，40岁。体重80kg，躯干背侧全部烧伤，2/3浅Ⅱ°，1/3为深Ⅱ°。入院后最初8小时的补液量是
A. 1560ml
B. 1780ml
C. 1872ml
D. 1936ml
E. 3560ml

正确答案：B。1780ml

解析：根据中国新九分法（P132表13-1），患者Ⅱ°烧伤面积为13%（躯干背侧）。伤后第1个24小时的总补液量=体重×Ⅱ°及Ⅲ°烧伤面积×1.5+水分基础需要量2000ml=80×13×1.5+2000=3560ml。第一个24小时的前8小时补液量为24小时总补液量的一半，即1780ml（B对）。